与立体构型改变有关的部位
A. V区
B. C区
C. 绞链区
D. 重链
E. 轻链

正确答案：C。绞链区